制订、实施国家食品安全风险监测计划的国家行政机关是
A. 国务院质量监督部门
B. 国务院卫生行政部门
C. 国家食品安全风险评估中心
D. 国务院食品药品监督管理部门
E. 国务院卫生行政部门会同国务院食品药品监督管理、质量监督等部门

正确答案：E。国务院卫生行政部门会同国务院食品药品监督管理、质量监督等部门

解析：本题考查制订、实施国家食品安全风险监测计划的国家行政机关。国务院卫生行政部门会同国务院食品药品监督管理、质量监督等部门（E对ABCD错），制定、实施国家食品安全风险监测计划。